实验流行病学设计研究，首先应明确
A. 研究目的
B. 抽样方法
C. 目标人群性质
D. 样本含量
E. 分析指标

正确答案：A。研究目的

解析：本题考查实验流行病学的步骤。实验流行病学是指研究者根据研究目的（A对BCDE错），按照预先确定的研究方案将研究对象随机分配到实验组和对照组，人为地施加或减少某种处理因素，然后追踪观察处理因素的作用结果，比较和分析两组人群的结局，从而判断处理因素的效果。